下列哪项不属经行吐衄的特点
A. 伴随月经周期发作
B. 月经周期紊乱
C. 经前4-5天吐血或衄血
D. 可见月经量减少或月经不行
E. 正值经行时吐血或衄血

正确答案：B。月经周期紊乱

解析：经行吐衄是指每逢经期或经行前后发生周期性吐血或衄血者（CE对）。故可伴随经期发作（A对），是以有规律的经期为前提，故月经周期紊乱不属于经行吐衄的特点（B错，为本题正确答案）。其诊断要点1.吐血、衄血随月经周期呈规律性发作，连续2次以上。2.伴月经量相应减少，甚或闭而不行（D对）。